公共场所经营单位的法人或负责人对公共场所负有多方面卫生管理责任，除了
A. 成立卫生管理机构，配备卫生管理人员
B. 组织制定危害健康事故预案
C. 加强禁烟控烟管理
D. 建立卫生管理制度和卫生管理档案
E. 禁止喧哗吵闹

正确答案：E。禁止喧哗吵闹

解析：本题考查公共场所经营单位的法人或负责人对公共场所应负的卫生管理责任。公共场所经营单位的法人或负责人是卫生安全的第一负责人，主要负有如下方面的责任：1.成立卫生管理机构，配备卫生管理人员（A对）；2.建立卫生管理制度和卫生管理档案（D对）；3.建立卫生培训制度和从业人员健康检查制度；4.配备健全卫生设施设备及维护制度；5.加强禁烟控烟管理（C对）；6.定期开展卫生检测；7.制定危害健康事故预案（B对）。不包括禁止喧哗吵闹（E错，为本题正确答案）